属于疾病自然史的阶段是
A. 结局
B. 临床期
C. 病理发生期
D. 症状发生前期
E. 以上均正确

正确答案：E。以上均正确

解析：疾病自然史：疾病从发生到结局（死亡或痊愈等）的全过程，其中有几个明确的阶段：①病理发生期；②症状发生前期；③临床期；④结局。掌握“预防医学概论、健康及三级预防策略”知识点。